属于后丘脑的结构是
A. 缰连合
B. 松果体
C. 外侧膝状体
D. 后连合
E. 缰三角

正确答案：C。外侧膝状体

解析：属于后丘脑的结构是外侧膝状体（C对）。缰连合（A错）、松果体（B错）、后连合（D错）、缰三角（E错）均为上丘脑的结构。